患者，女，38岁，因缺铁性贫血口服多糖铁复合物胶囊。关于该患者用药注意事项的说法，正确的有
A. 在血红蛋白水平恢复正常后，仍需补充4～6个月铁剂
B. 铁剂可能会引起粪便颜色变黑
C. 服用铁剂期间应限制蛋白质的摄入
D. 多糖铁复合物的耐受性优于硫酸亚铁
E. 多糖铁复合物为无机铁剂，含铁量高

正确答案：A、B、D。在血红蛋白水平恢复正常后，仍需补充4～6个月铁剂；铁剂可能会引起粪便颜色变黑；多糖铁复合物的耐受性优于硫酸亚铁

解析：本题考查缺铁性贫血患者教育。铁剂治疗有效者，在血红蛋白水平恢复正常后，仍需补充4～6个月铁剂（A对）以补足储存铁，或在血清铁蛋白升至30～50㎍/L后再停药。铁剂可能会引起粪便颜色变黑（B对）。多糖铁复合物的耐受性优于硫酸亚铁（D对）。服用铁剂期间应增加蛋白质的摄入（C错），促进铁剂吸收。右旋糖酐铁、琥珀酸亚铁和多糖铁复合物是有机铁剂（E错），其含铁量高，口服不良反应较硫酸亚铁轻，而疗效相当。